刺激性气体的刺激反应，不包括
A. 眼结膜充血、流泪
B. 流鼻涕、打喷嚏
C. 呛咳、胸闷
D. 接触性皮炎
E. 咽痛、咽部充血

正确答案：D。接触性皮炎

解析：本题考查刺激性气体的刺激反应。吸入刺激性气体时，会产生一过性眼和上呼吸道刺激症状。导致眼结膜充血、流泪（A对）等眼刺激症状和流鼻涕、打喷嚏（B对），呛咳、胸闷（C对），咽痛、咽部充血（E对）等一系列上呼吸道刺激症状。接触刺激性气体不会导致产生接触性皮炎（D错，为本题正确答案）的症状。